口腔颌面部因炎症而引起的囊肿主要是
A. 根尖囊肿
B. 黏液囊肿
C. 舌下囊肿
D. 始基囊肿
E. 牙龈囊肿

正确答案：A。根尖囊肿

解析：本题考查颌骨囊肿。根端囊肿（根尖囊肿）（A对）是颌骨内最常见的牙源性囊肿，属于炎症性囊肿，多是由于慢性炎症的刺激，引起牙周膜内的上皮残余增生，增生的上皮团中央发生变性与液化，周围组织液不断渗出，从而逐渐形成囊肿。黏液囊肿（B错）与舌下囊肿（C错）是因小涎腺导管破裂或阻塞所致的黏液外渗或潴留而发生的软组织囊肿。始基囊肿（D错）发生于成釉器发育的早期阶段，牙釉质和牙本质形成之前，在损伤刺激后，成釉器的星网状层发生变性并有液体渗出，液体蓄积其中从而形成囊肿。牙龈囊肿（E错）来源于牙板上皮剩余或龈上皮钉突的囊性变，也可为外伤性植入上皮，上皮中央角化、脱落从而形成囊肿。